痈切开引流术与其他脓肿不同，除一般要点外，正确的引流切口应选择
A. 切口要大
B. 切口应深
C. 作低位切口
D. 作多个平行切口
E. 作“﹢”或“﹢﹢"形切口

正确答案：E。作“﹢”或“﹢﹢"形切口